细菌“核质以外的遗传物质”指
A. mRNA
B. 核蛋白体
C. 质粒
D. 异染颗粒
E. 性菌毛

正确答案：C。质粒

解析：细菌“核质以外的遗传物质”指质粒（C对），质粒是存在于细菌染色体外的小型环状双链DNA分子，能在宿主细胞独立自主地进行复制，稳定地传给子代细胞。mRNA（A错）是DNA转录生成的，可翻译为蛋白质。核蛋白体（B错）、异染颗粒（D错）及性菌毛（E错）均非细菌的遗传物质。